根据《处方管理办法》，关于处方权的说法，正确的是
A. 执业医师在合法医疗机构均有相应的处方权
B. 经注册的执业助理医师在其执业的县级医院可取得相应的处方权
C. 医师应当在注册的医疗机构签名留样或者专用印章备案后，方可开具处方
D. 执业医师经考核合格取得麻醉药品处方权后，可按照规定为自己开具麻醉药品处方
E. 进修医师在其进修的医疗机构直接拥有相应的处方权

正确答案：C。医师应当在注册的医疗机构签名留样或者专用印章备案后，方可开具处方

解析：本题考查的是处方权的获得。根据《处方管理办法》，关于处方权的说法，正确的是医师应当在注册的医疗机构签名留样或者专用印章备案后，方可开具处方（C对）。处方权的获得：经注册的执业医师在执业地点取得相应的处方权（A错）。经注册的执业助理医师在乡、民族乡、镇、村的医疗机构独立从事一般的执业活动，可以在注册的执业地点取得相应的处方权（B错）。经注册的执业助理医师在医疗机构开具的处方，应当经所在执业地点执业医师签名或加盖专用签章后方有效。试用期人员开具处方，应当经所在医疗机构有处方权的执业医师审核并签名或加盖专用签章后方有效。医师应当在注册的医疗机构签名留样或者专用签章备案后，方可开具处方。医疗机构应当对本医疗机构执业医师和药师进行麻醉药品和精神药品使用知识和规范化管理的培训。执业医师经考核合格后取得麻醉药品和第一类精神药品的处方权，药师经考核合格后取得麻醉药品和第一类精神药品调剂资格。医师取得麻醉药品和第一类精神药品处方权后，方可在本医疗机构开具麻醉药品和第一类精神药品处方，但不得为自己开具该类药品处方（D错）。药师取得麻醉药品和第一类精神药品调剂资格后，方可在本医疗机构调剂麻醉药品和第一类精神药品。《处方管理办法》第三章处方权的获得第十三条：进修医师由接收进修的医疗机构对其胜任本专业工作的实际情况进行认定后授予相应的处方权（E错）。